能与受体结合，具有较强亲和力而无内在活性的药物称为
A. 激动药
B. 抗真菌药
C. 拮抗药
D. 抗结核药
E. 抗病毒药

正确答案：C。拮抗药

解析：能与受体结合，具有较强亲和力而无内在活性（α=0）的药物称为拮抗药。掌握“药物与受体、剂量与效应关系”知识点。